患者，女，60岁。反复发作胸闷胸痛半月余，气短痰多，肢体沉重，形体肥胖，纳呆恶心，舌苔浊腻，脉滑。心电图V₃、V₄、V₅、V₆导联，ST段下移，T波倒置。其证型是
A. 阴寒凝滞证
B. 气虚血瘀证
C. 痰浊内阻证
D. 心血瘀阻证
E. 心肾阳虚证

正确答案：C。痰浊内阻证

解析：患痰浊盘踞，胸阳失展，故见反复发作胸闷胸痛半月余；气机不畅故气短痰多；脾主四肢，痰浊困脾，脾气不运，故肢体沉重，形体肥胖，纳呆恶心；舌苔浊腻，脉滑为痰浊壅阻之侯（C对）。阴寒凝滞证（A错）的特点为猝然胸痛如绞，天冷易发，感寒痛甚，形寒，甚则四肢不温，冷汗自出，心悸短气，舌质淡红，苔白，脉沉细或沉紧。气虚血瘀证（B错）的特点为胸痛隐隐，时轻时重，遇劳则发，神疲乏力，气短懒言，心悸自汗。心血瘀阻证（D错）的特点为胸痛较剧，如刺如绞，痛有定处，入夜加重，伴有胸闷，或因暴怒而致心胸剧痛。心肾阳虚证（E错）的特点为心悸而痛，胸闷气短，甚则胸痛彻背，心悸汗出，畏寒肢冷，下肢浮肿，腰酸无力。